三氯化铁为常用的混凝剂，其特点为
A. 腐蚀性小，易潮湿，适应pH范围较广对水质无不良影响，絮凝体大而紧密
B. 腐蚀性大，适应pH范围较广，对水质无不良影响，效果一般
C. 腐蚀性小，对水质有些影响，水温低时絮凝体形成较紧密
D. 腐蚀性小，对水质无不良影响，但使用不方便
E. 腐蚀性大，易潮湿，适应pH范围较广，水处理后含铁量高，絮凝体大而紧密

正确答案：E。腐蚀性大，易潮湿，适应pH范围较广，水处理后含铁量高，絮凝体大而紧密

解析：本题考查三氯化铁的特点。三氯化铁是具有金属光泽的黑褐色结晶，易溶于水，含杂质少。操作液浓度宜高，可达45%。其优点是：适用的pH范围较广（5～9），絮凝体大而紧密；对低温、低浊水的效果较铝盐好。缺点是：腐蚀性强，易潮湿，水处理后含铁量高（E对ABCD错）。